消化道造影所示食管中下段的黏膜皱襞明显增宽迂曲，呈蚯蚓状或串珠状充盈缺损，管壁边缘呈锯齿状应考虑的疾病是
A. 食管癌
B. 食管静脉曲张
C. 反流性食管炎
D. 正常食管影像
E. 食管异物

正确答案：B。食管静脉曲张

解析：食管静脉曲张X线表现：早期食管静脉曲张发生于食管下段，表现为黏膜皱襞稍增粗、增宽或略有迂曲，有时因皱襞显示不连续而如虚线状。晚期病情发展到典型阶段，表现为食管中、下段黏膜皱襞明显增宽、迂曲，呈蚯蚓状或串珠状充盈缺损，管壁边缘呈锯齿状（B对）。食管癌X线表现：①黏膜皱襞改变（由于肿瘤破坏黏膜层，使正常皱襞消失、中断、破坏，形成表面杂乱的不规则影像）、管腔狭窄、腔内充盈缺损（A错）。反流性食管炎内镜下表现为食管黏膜的破损（C错）。正常食管影像表现为黏膜皱襞数条纵行、相互平行的纤细条状阴影（D错）。对于鱼刺、肉骨等在X线下不显影的异物，应行食管钡剂X线检查，以确定异物是否存在及所在部位。对于在X线下不显影的异物，可直接作X线拍片定位（E错）。